患者，女，43岁。左下后牙肿痛3天就诊。检查见左下第一磨牙远中颈部龋，龋深及牙髓。无探痛，Ⅲ度松动，叩痛（+++），颊侧根尖部龈红肿，扪痛，有波动感,左面下部轻度肿胀，体温38℃。诊断最可能是
A. 急性化脓性牙髓炎
B. 急性化脓性根尖周炎
C. 急性颌骨骨髓炎
D. 急性牙周脓肿
E. 急性蜂窝织炎

正确答案：B。急性化脓性根尖周炎

解析：急性化脓性根尖周炎（急性牙槽脓肿）自觉症状：疼痛很剧烈，呈持续性，搏动性痛；患牙明显伸长，不敢咬合；严重者还伴有乏力、发热、烦躁和便秘等全身症状。临床检查：牙髓无活力，温度测和电测无反应；叩痛（+++）、Ⅲ度松动、相应部位牙龈红肿、扪痛。急性化脓性根尖周炎的过程经历三个阶段，其临床表现如下：
①根尖周脓肿：自发持续性剧烈跳痛，伸长感加重，触痛重，叩痛（+++），松动Ⅱ～Ⅲ度，患牙根尖部相应的唇、颊侧牙龈潮红，有扪痛、肿胀不明显。②骨膜下脓肿：上述症状加重，患者痛苦面容、根尖区牙龈肿胀明显、移行沟变平，扪痛并有深部波动感；区域淋巴结肿大、压痛，相应面颊部软组织呈反应性水肿；全身不适，体温升高（38℃左右），末梢血象白细胞增多（计数1.0万～1.2万/mm3）。③黏膜下脓肿：上述症状明显减轻，相应根尖部的牙龈肿胀局限，呈半球形隆起，叩痛（+++），扪诊波动感明显，全身症状缓解。掌握“急性根尖周炎”知识点。